与胰体的前面隔网膜囊相邻的解剖结构是
A. 胃后壁
B. 胆总管
C. 肝右动脉
D. 肝门胆管
E. 腹主动脉

正确答案：A。胃后壁

解析：与胰体的前面隔网膜囊相邻的解剖结构是胃后壁（A对）。胆总管（B错）、肝右动脉（C错）、肝门胆管（D错）、腹主动脉（E错）位于胰腺的后方。